下列哪个腧穴是治疗小儿疳积、百日咳的首选穴
A. 肺俞
B. 四缝
C. 膏肓
D. 足三里
E. 关元

正确答案：B。四缝

解析：四缝（B对）是治疗小儿疳积的要穴，主治小儿疳积、百日咳；肺腧（A错）主治咳嗽、气喘、咯血、骨蒸潮热、盗汗；膏肓（C错）主治咳嗽气喘、肺痨、健忘、遗精盗汗等虚损诸疾；足三里（D错）主治胃肠疾患、下肢病变、以及虚劳羸瘦；关元（E错）主治遗精盗汗、月经不调、以及虚劳病症。